老年肾虚患者，大便秘结，小便清长头目眩晕，腰膝痠软。治疗应首选
A. 肾气丸
B. 济川煎
C. 真武汤
D. 地黄饮子
E. 六味地黄丸

正确答案：B。济川煎

解析：本题考查常见的病症的辩证、处方。题中患者老年肾虚患者，大便秘结，小便清长头目眩晕，腰膝痠软，可辩证为肾阳虚弱，精津不足证。肾气丸为补益剂，具有补肾助阳之功效。主治肾阳不足证。腰痛脚软，身半以下常有冷感，少腹拘急，小便不利，或小便反多，入夜尤甚，阳痿早泄，舌淡而胖，脉虚弱，尺部沉细或沉弱而迟，以及痰饮，水肿，消渴，脚气，转胞等（A错）。济川煎为泻下剂，润下，具有温肾益精，润肠通便之功效。主治肾阳虚弱，精津不足证。大便秘结，小便清长，腰膝酸软，头目眩晕，舌淡苔白，脉沉迟（B对）。真武汤为祛湿剂，具有温阳利水之功效。主治阳虚水泛证。畏寒肢厥，小便不利，心下悸动不宁，头目眩晕，身体筋肉瞤动，站立不稳，四肢沉重疼痛，浮肿，腰以下为甚；或腹痛，泄泻；或咳喘呕逆。舌质淡胖，边有齿痕，舌苔白滑，脉沉细（C错）。地黄饮子，为补益剂，具有滋肾阴，补肾阳，开窍化痰之功效。主治下元虚衰，痰浊上泛之喑痱证。舌强不能言，足废不能用，口干不欲饮，足冷面赤，脉沉细弱（D错）。六味地黄丸为补益剂，具有滋阴补肾之功效。用于肾阴亏损，头晕耳鸣，腰膝酸软，骨蒸潮热，盗汗遗精，消渴（E错）。